细胞和组织的适应性反应不包括
A. 化生
B. 萎缩
C. 再生
D. 肥大
E. 增生

正确答案：C。再生

解析：细胞和组织的适应性反应是指，细胞和组织对于内、外环境中的持续性刺激和各种有害因子所产生的非损伤性应答反应，包括化生（A对）、萎缩（B对）、肥大（B对）和增生（E对）。再生（C错，为本题正确答案）是指机体出现损伤时，以损伤周围的同种细胞对缺损进行修补恢复的过程，不属于适应性反应。